男性，60岁，因胃溃疡合并多次大出血，行胃大部切除术。术后10天，已进流质饮食，突然出现呕吐，禁食后症状好转。钡餐检查见输出段有较长狭窄，形似漏斗。该病人可选择的治疗措施不包括
A. 胃肠减压
B. 输血
C. 应用皮质激素
D. 肌肉注射新斯的明
E. 即刻手术

正确答案：E。即刻手术

解析：胃大部切除术后数日，从流质改为半流质饮食的过程中出现呕吐，应考虑胃排空障碍。胃排空障碍分整个吻合口胃排空障碍、输出襻空肠口胃排空障碍两种类型。根据钡餐结果可知，该患者的排空障碍是在输出段空肠口。无论何种类型的排空障碍，其本质均属于动力性胃通过障碍、无器质性病变，病人经保守治疗后可好转，无需再次手术治疗（E错，为本题正确选项），此时可进行保守治疗，禁食、胃肠减压（A对）、输血（支持治疗）（B对），肌注新斯的明（促进胃动力）（D对），应用糖皮质激素（口服强的松）（C对）等都是可施行的保守治疗措施。